X线可见双膝关节间隙变窄，关节面变平，边缘有骨赘突出，软骨下骨质致密，关节面下方骨内呈不规整形透明区应考虑的疾病是
A. 双膝关节结核
B. 双膝关节骨质增生
C. 双膝关节囊肿
D. 双膝关节肿瘤
E. 双膝关节退行性改变

正确答案：E。双膝关节退行性改变

解析：关节退行性变的早期双膝关节退行性改变时关节软骨出现磨损、退变，并且逐渐的形成关节的骨性增生以及钙化，导致关节间隙变得比较窄（E对）。双膝关节结核X线片显示为局限性的、边缘尚清楚的类圆形骨质密度减低的破坏区，其周围无骨质硬化现象，偶在其中可见死骨碎屑影。附近无骨膜反应，患骨骨质疏松，病变部位软组织肿胀（A错）。骨质增生X线表现为骨密度增高，伴或不伴骨骼增大（B错）。骨囊肿X线表现，病变位于长骨干骺端椭圆形溶骨性破坏，边界清楚，可有分隔，骨皮质膨胀变薄（C错）。双膝关节肿瘤①溶骨型：自骨髓腔和骨松质发展的溶骨性破坏，形成边缘模糊的密度减低区，其中不见骨组织或少见斑片状包壳骨影，骨皮质逐渐破坏。②成骨型（硬化型）：病灶区呈无结构的磨玻璃样斑片状或大片状致密的骨质硬化改变，如象牙质变。早期骨皮质完整，以后则破坏。③混合型：多数病变兼有溶骨型和成骨型的骨质改变。可以成骨为主，或以溶骨为主。病变区骨膜可呈成层型或放射型，在肿瘤突破骨膜处可见袖口征样改变，即形成骨膜三角影（D错）。